糖尿病最常见的精神症状是
A. 焦虑症状
B. 幻觉妄想
C. 抑郁情绪
D. 偏执状态
E. 意识障碍

正确答案：C。抑郁情绪

解析：糖尿病中最常见的精神症状是抑郁情绪（C对）。除抑郁情绪外，糖尿病患者还可出现焦虑（A错）、偏执状态（D错）和脑衰弱综合征等症状，但均不是最常见症状。